男，25岁，体重50Kg，Ⅱ°以上烧伤面积40%，其第1个24小时的前8小时内补液量为
A. 1000ml
B. 1500ml
C. 2000ml
D. 2500ml
E. 3000ml

正确答案：D。2500ml

解析：患者男性25岁，体重50kg，烧伤面积为40％，根据烧伤补液原则（P142-P143），第一个24小时补液总量=体重×Ⅱ°、Ⅲ°烧伤面积×1.5+基础水分2000ml=50×40×1.5＋2000=5000ml，第1个24小时的前8小时内补液量为第一个24小时补液总量的一半即2500ml（D对）。